何种结构不属于心血管系统？
A. 静脉
B. 动脉
C. 淋巴管
D. 毛细血管
E. 心

正确答案：C。淋巴管

解析：静脉（A对）、动脉（B对）、毛细血管（D对）、心（E对）均属于心血管系统。淋巴管（C错，为本题正确答案）不属于心血管系统，属于淋巴系统。